《中华人民共和国药品管理法》规定，药品监督管理部门批准开办药品经营企业，除依据应具备的开办条件规定外，还应遵循的原则是
A. 公平合理和诚实信用
B. 市场需求和社会承受力
C. 安全有效和市场需求
D. 质量第一和方便群众购药
E. 合理布局和方便群众购药

正确答案：E。合理布局和方便群众购药